不属于可摘局部义齿的部件是
A. 间接固位体
B. 直接固位体
C. 桥体
D. Ⅰ杆
E. 邻面板

正确答案：C。桥体

解析：本题考查局部义齿人工牙及基托。桥体（C错，为本题正确答案）是固定桥特有的部件，不属于可摘局部义齿的部件。